女子婚后同居2年，未避孕而未受孕，应属
A. 断绪
B. 继发性不孕
C. 断产
D. 全不产
E. 五不女

正确答案：D。全不产

解析：女子婚后同居2年，未避孕而未受孕属于不孕症范畴，且根据题干信息可判断为原发性不孕。不孕症是指妇女婚后未避孕、有正常性生活、夫妇同居1年而未孕；分为原发性和继发性两类。其中既往从未有过妊娠史，无避孕且从未妊娠者称为原发性不孕；既往有过妊娠史，而后无避孕连续1年未妊娠者称为继发性不孕。中医学将原发性不孕称为：“全不产”（D对）“绝产”“绝嗣”“绝子”等，继发性不孕称为“断绪”（AB错）。断产是绝育的意思（C错）。五不女是指女子先天性生理缺陷，即螺、纹、鼓、角、脉五种，前人认为这类情况没有生育能力（E错）。